根据五行相生规律的治法中
A. 培土生金法
B. 滋水涵木法
C. 金水相生法
D. 益火补土法
E. 抑木扶土法

正确答案：A、B、C、D。培土生金法；滋水涵木法；金水相生法；益火补土法

解析：本题考查的是根据相生规律确定的治则治法。根据五行相生规律的治法中培土生金法（A对）、滋水涵木法（B对）、金水相生法（C对）、益火补土法（D对）。根据相生规律确定的治法，主要有滋水涵木法、培土生金法、金水相生法、益火补土法等。抑木扶土法（E错）是根据五行相克规律的治法。根据五行相克规律确定的治法，主要有抑木扶土法、培土制水法、佐金平木法、泻南补北法等。